自觉咽中如物梗塞，吐之不出，吞之不下，但不妨碍进食的病证是
A. 反胃
B. 噎膈
C. 噫气
D. 呃逆
E. 梅核气

正确答案：E。梅核气

解析：肝郁乘脾，脾运不健，生湿聚痰，痰气郁结于胸膈之上，故自觉咽中不适如物梗塞，吐之不出，咽之不下。故辩证为郁证痰气郁结证，又称梅核气（E对）。反胃是指饮食入胃，宿谷不化，经过良久，由胃反出之病（A错）。噎膈是指吞咽食物哽噎不顺，饮食难下，或纳而复出的疾患（B错）。噫气又称嗳气，为胃气阻郁，气逆于上，冲咽而出，发出沉缓的嗳气声，常伴酸腐气味，食后多发（C错）。呃逆是指胃气上逆动膈，以气逆上冲，喉间呃呃连声，声短而频，难以自制为主要表现的病证（D错）。